伦理道德主要通过什么影响人们的健康
A. 生活环境
B. 劳动条件
C. 心理
D. 精神生活
E. 生活方式

正确答案：E。生活方式